血管神经性水肿最好发的部位是
A. 上唇
B. 下唇
C. 上眼睑
D. 下眼睑
E. 下颌下

正确答案：A。上唇

解析：血管神经性水肿是一种发生于皮下疏松组织或黏膜的局限性水肿，为一种暂时性、局限性、无痛性皮下黏膜下水肿，好发于上唇。掌握“血管神经性水肿”知识点。